某女，60岁。患新型冠状病毒肺炎（轻型），症见发热、咳嗽、胸闷、乏力，伴鼻塞、咽痛；舌苔白，脉浮。根据中医藏象理论，其病机是
A. 肺通调水道功能失常
B. 肺宣发肃降功能失常
C. 肺朝百脉功能失常
D. 肺主气功能失常
E. 肺合皮毛功能失常

正确答案：B。肺宣发肃降功能失常

解析：本题考查肺藏象的生理功能症状。根据中医藏象理论，其病机是肺宣发肃降功能失常（B对）。肺主宣发与肃降：在病变情况下，“肺气失宣”，可见鼻塞、喷嚏、恶寒、无汗、呼吸不畅、胸闷、喘咳等症状；“肺失肃降”，可见呼吸短促、喘息、咳痰等症状。肺通调水道功能（A错）：是指肺气宣发和肃降对于体内津液代谢具有疏通和调节的作用。主要体现在两个方面：一是肺气宣发，不但将津液和水谷精微布散于周身，而且主司腠理的开合，调节汗液的排泄，使汗液排出正常。二是肺气肃降，可将体内的水液不断地向下输送，经肾和膀胱的气化作用，生成尿液而排出体外。肺在调节津液代谢中发挥重要作用，故又称“肺为水之上源”和“肺主行水”等。肺朝百脉（C错）：是指全身的血液，都通过经脉而会聚于肺，通过肺的呼吸，进行气体的交换，然后再输布到全身。血液的正常循行，亦有赖于肺气的正常敷布和调节，即肺气具有辅心行血的作用。肺主治节：指肺具有治理调节呼吸及全身之气、血、津液的功能。主要体现在四个方面：一是治理调节呼吸运动；二是治理调节一身之气的生成和运动；三是治理调节血液的运行；四是治理调节津液的输布代谢。由此可见，肺主治节，是对肺的主要生理功能的高度概括。肺主气（D错），司呼吸（1）肺主呼吸之气：肺是体内外气体交换的场所，人体通过肺，从自然界吸入清气，呼出体内的浊气，吐故纳新，使体内外的气体不断交换，从而保证了人体新陈代谢的正常进行。（2）肺主一身之气：肺吸入的清气与脾胃运化的水谷精气，在胸中相合生成宗气，贯心脉以行心血；并且，肺气的升降出入运动对全身气机具有调节作用，故“诸气者，皆属于肺”。肺合皮毛功能（E错）：一是肺具有宣发卫气和津液以营养滋润皮肤毫毛的作用；二是汗孔排泄汗液有协助肺排泄废物的作用。汗孔排泄汗液，可以调节体温，排出部分代谢废物；又宣散肺气，以调节呼吸，故《内经》把汗孔称作“玄府”，又叫“气门”。